哺乳期用奶瓶喂奶的幼儿有时易患
A. 急性龋
B. 慢性龋
C. 奶瓶龋
D. 静止龋
E. 猖獗性龋

正确答案：C。奶瓶龋

解析：本题考查乳牙龋病。哺乳期用奶瓶喂奶的幼儿，如果养成不良喂养习惯，如含奶瓶入睡、牙齿萌出后喂夜奶、延长母乳或奶瓶喂养时间、过多饮用含糖饮料等，易形成喂养龋，又称奶瓶龋（C对）。急性龋（A错）、慢性龋（B错）、静止龋（D错）是按照疾病的进展速度对龋病进行的分类，与奶瓶喂养无明显关系。猖獗性龋（E错）多发生于喜好食用含糖量高的糖果、糕点或饮料而又不注意口腔卫生的幼儿。